根据《关于建立国家基本药物制度的实施意见》，国家基本药物工作委员会的职能不包括
A. 确定国家基本药物目录遴选原则、范围、程序
B. 确定国家基本药物目录遴选和调整的工作方案
C. 确定国家基本药物制度框架
D. 审核国家基本药物目录
E. 制定国家基本药物最高零售指导价格

正确答案：E。制定国家基本药物最高零售指导价格

解析：本题考查的是国家基本药物工作委员会的职能。根据《关于建立国家基本药物制度的实施意见》，国家基本药物工作委员会的职能不包括制定国家基本药物最高零售指导价格（E错，为本题正确答案）。国家基本药物工作委员会负责协调解决制定和实施国家基本药物制度过程中各个环节的相关政策问题，确定国家基本药物制度框架（C对），确定国家基本药物目录遴选和调整的原则、范围、程序和工作方案（AB对），审核国家基本药物目录（D对）。